上颌第一磨牙内哪一个髓角最高
A. 近中舌侧
B. 近中颊侧
C. 远中颊侧
D. 远中舌侧
E. 第五牙尖处

正确答案：B。近中颊侧

解析：本题考查上颌磨牙的髓腔形态。上颌第一磨牙内近中颊侧（B对）髓角最高。上颌第一磨牙近中颊侧髓角最高，髓角从高到低的排列是近中颊侧髓角，近中舌侧髓角，远中颊侧髓角和远中舌侧髓角。